使用30%～50%磷酸酸蚀刻成年恒牙釉质的时间应控制在
A. 10～20秒
B. 20～40秒
C. 1～2分钟
D. 2～4分钟
E. 40～60秒

正确答案：B。20～40秒

解析：用磷酸进行酸蚀刻的效果最优，脱矿均匀，以30%～50%磷酸酸蚀刻釉质20～40秒为宜。掌握“树脂粘结概念及釉质、牙本质粘结”知识点。